具有抑制过敏介质释放的作用，用于预防哮喘发作的药物
A. 色甘酸钠
B. 吗啡
C. 利多卡因
D. 利福平
E. 二甲双胍

正确答案：A。色甘酸钠

解析：色甘酸钠等具有抑制过敏介质释放的作用，用于预防哮喘发作。掌握“平喘药”知识点。